医患关系的重要性不包括
A. 提高病人依从性
B. 有利于医患关系模式转变为共同参与型
C. 造就良好的心理气氛
D. 提高病人的社交能力
E. 本身就是一种治疗手段

正确答案：D。提高病人的社交能力